用于铜、汞、铅中毒的解毒药物是
A. 青霉胺
B. 亚硝酸钠
C. 谷胱甘肽
D. 亚甲蓝
E. 右旋糖酐

正确答案：A。青霉胺

解析：本题考查铜、汞、铅中毒解救。青霉胺（D-盐酸青霉胺）（A对）用于铜、汞、铅中毒的解毒，治疗肝豆状核变性病。亚硝酸钠（B错）治疗氰化物中毒。谷胱甘肽（C错）用于丙烯腈、氟化物、一氧化碳、重金属等中毒。亚甲蓝（D错）用于氰化物中毒，小剂量可治疗高铁血红蛋白血症（亚硝酸盐中毒等）。